男，66岁。右髋部疼痛，活动受限半年余。2年前因右股骨颈骨折行空心钉内固定治疗。查体：右髋关节内旋和外旋受限。X线检查示右股骨头负重区出现新月征、囊性变。最可能的诊断是
A. 化脓性髋关节炎
B. 股骨颈骨折不愈合
C. 股骨头缺血性坏死
D. 髋关节结核
E. 类风湿关节炎

正确答案：C。股骨头缺血性坏死

解析：老年男性患者，右股骨颈骨折内固定后，右髋部疼痛、活动受限（股骨头坏死典型表现），查体发现右髋关节内旋和外旋受限（股骨头缺血性坏死典型体征），X线示右股骨头负重区出现新月征、囊性变（股骨头坏死典型影像学表现），结合患者病史、体查和影像学表现，该患者最可能的诊断为股骨头缺血性坏死（C对）。化脓性髋关节炎（A错）（P746）好发于儿童，起病急骤，主要表现为寒战高热等脓毒症状，髋关节常处于屈曲、外旋、外展位，X线典型表现出现较晚。股骨颈骨折不愈合（B错）好发于老年人股骨颈骨折，尤其是股骨颈头下型骨折，X线表现为骨折端无骨痂，断端分离、萎缩，骨再生不明显。髋关节结核（D错）（P757）主要表现为长期低热、盗汗乏力等结核中毒症状，早期患肢呈现屈曲、外展、外旋畸形，随病情发展表现为屈曲、内收、内旋畸形，X线特征性表现为区域性骨质疏松和周围少量钙化的骨质破坏病灶，周围可见软组织肿胀。类风湿关节炎（E错）（P766）主要累及近端小关节，髋关节受累者少见。